某女，70岁，患白疕15年，刻下症见皮疹为点滴状、基底鲜红色、表面覆有银白色鳞屑、瘙痒较甚。证属血热风燥，宜选用的成药是
A. 消风止痒颗粒
B. 消银颗粒
C. 玉屏风颗粒
D. 连翘败毒丸
E. 防风通圣丸

正确答案：B。消银颗粒

解析：本题考查的是消银颗粒的主治。患白疕15年，刻下症见皮疹为点滴状、基底鲜红色、表面覆有银白色鳞屑、瘙痒较甚。证属血热风燥，宜选用的成药是消银颗粒（B对）。消银颗粒：【主治】血热风燥型白疕和血虚风燥型白疕，症见皮疹为点滴状、基底鲜红色、表面覆有银白色鳞屑，或皮疹表面覆有较厚的银白色鳞屑、较干燥、基底淡红色、瘙痒较甚。消风止痒颗粒（A错）：【主治】风湿热邪蕴阻肌肤所致的湿疮、风疹瘙痒、小儿瘾疹，症见皮肤丘疹、水疱、抓痕、血痂、或见梭形或纺锤形水肿性风团、中央出现小水疱、瘙痒剧烈；湿疹、皮肤瘙痒症、丘疹性荨麻疹见上述证侯者。玉屏风颗粒（C错）：【主治】表虚不固所致的自汗，症见自汗恶风、面色㿠白，或体虚易感风邪者。连翘败毒丸（D错）：【主治】热毒蕴结肌肤所致的疮疡，症见局部红肿热痛、未溃破者。防风通圣丸（E错）：【主治】外寒内热，表里俱实，恶寒壮热，头痛咽干，小便短赤，大便秘结，瘰疬初起，风疹湿疮。